下列哪项不属于阴阳一体观
A. 阴阳双方在一个统一体中，协调共济
B. 阴阳任何一方都不能脱离另一方而单独存在
C. 阴阳每一方都涵有另一方
D. 阴阳对立制约
E. 阴阳分之为二，合二为一

正确答案：D。阴阳对立制约

解析：阴阳一体观的含义是指①阴阳虽然对立相反，但在一个统一体中协调共济（AE对）。②统一体中阴阳双方相互依赖而存在，任何一方都不能脱离另一方而单独存在（B对），这就是阴阳的相互依存。③统一体内的阴阳双方，每一方都涵有另一方（C对），阴中含阳，阳中寓阴，即所谓的阴阳互藏（D错，为本题正确答案）。